多生牙修复治疗时应考虑
A. 观察
B. 牙髓治疗
C. 不作处理
D. 调磨后仍影响修复考虑拔除
E. 无需处理直接拔除

正确答案：D。调磨后仍影响修复考虑拔除

解析：本题考查修复前准备。如错位牙、多生牙、倾斜牙、阻生牙等经过调磨或正畸治疗后，仍然严重影响修复治疗时应考虑拔除（D对）。